不属于反治法的是
A. 以热治热
B. 以补开塞
C. 以寒治寒
D. 以热治寒
E. 以通治通

正确答案：D。以热治寒

解析：本题考查的是反治。以通治通属于正治法（D错，为本题正确答案）。反治，主要包括热因热用、寒因寒用、塞因塞用、通因通用四种治法。1.热因热用：热因热用又称“以热治热（A对）”，是指针对假热的临床表现，用热性药物来进行治疗。2.寒因寒用：寒因寒用又称“以寒治寒（C对）”，是指针对假寒的临床表现，用寒性药物进行治疗。3.塞因塞用：塞因塞用又称“以补开塞（B对）”，是指针对闭塞不通的临床表现，用补虚药物进行治疗。4.通因通用：通因通用又称“以通治通（E对）”，是指针对通泄的临床表现，用通利药物进行治疗。以热治寒属于正治法。常用的正治法有寒者热之、热者寒之、虚则补之、实则泻之等。1.寒者热之：寒者热之又称“以热治寒”，是指寒性病证出现寒象，用温热方药进行治疗。2.热者寒之：热者寒之又称“以寒治热”，是指热性病证出现热象，用寒凉方药进行治疗。3.虚则补之：虚则补之是指虚损性病证出现虚象，用补益方药进行治疗。4.实则泻之：实则泻之是指实性病证出现实象，用攻逐邪实的方药进行治疗。